下列各项，不属于放置宫内节育器禁忌证的是
A. 滴虫性阴道炎
B. 月经过多
C. 重度痛经
D. 宫颈口松
E. 足月产后3个月

正确答案：E。足月产后3个月

解析：放置宫内节育器的禁忌证有：生殖器官炎症，如急性盆腔炎，阴道炎（滴虫性阴道炎）（A对），重度宫颈糜烂等；月经紊乱，如近3个月月经过多（B对），月经频发或不规则阴道流血，重度痛经等（C对）；生殖器官肿瘤，宫颈口过松、重度子宫脱垂等（D对）。足月产后3月为宫内节育器放置恰当时间（E错，为本题正确答案）。